下列哪项属于病理性汗出
A. 衣被过厚
B. 剧烈活动
C. 进食辛辣
D. 气候炎热
E. 睡眠之时

正确答案：E。睡眠之时

解析：盗汗多见于阴虚证。因阴虚阳亢，虚热内生，入睡（E对）则卫阳由表入里，肌表不固，内热加重，蒸津外泄而汗出；醒后卫阳由里出表，内热减轻而肌表得以固密，故汗出止。常兼见潮热，舌红少苔，脉细数等症状。汗是阳气蒸化津液经玄府达于体表而成。故《素问·阴阳别论）说：“阳加于阴谓之汗”。正常汗出有调和营卫、调节体温、滋润皮肤的作用。正常人在衣被过厚（A错）、体力活动（B错）、进食辛辣（C错）、气候炎热（D错）、情绪激动等情况下容易出汗，属于正常生理现象。